药物副作用是指：
A. 药物蓄积过多引起的反应
B. 在治疗剂量时，机体出现与治疗目的无关的不适反应
C. 停药后血药浓度已降至阈浓度以下时产生的不适反应
D. 极少数人对药物特别敏感产生的反应
E. 过量药物引起的肝、肾功能障碍

正确答案：B。在治疗剂量时，机体出现与治疗目的无关的不适反应